一定时期内，患某病的全部患者因该病死亡者所占的比例
A. 患病率
B. 病死率
C. 续发率
D. 死亡率
E. 感染率

正确答案：B。病死率

解析：病死率表示一定时期内，患某病的全部患者中因该病死亡者所占的比例。掌握“流行病学资料与疾病分布”知识点。